治疗肺炎咳吐黄稠脓痰者，应首选
A. 清营汤
B. 化斑汤
C. 白虎汤
D. 苇茎汤
E. 止嗽散

正确答案：D。苇茎汤

解析：咳吐黄稠脓痰，为痰热壅肺之征，治宜清热化痰，宽胸止咳，宜用清肺化痰，逐瘀排脓的苇茎汤（D对）。清营汤功用清营解毒，透热养阴，主治热入营分证，为治疗肺炎热陷心包证的代表方（A错）。化斑汤主治气血两燔之发斑，症见发热或身热夜甚，外透斑疹，色赤等（B错）。白虎汤功用清热生津，主治阳明气分热盛证（C错）。止嗽散功用宣利肺气，疏风止咳，主治风邪犯肺之咳嗽证（E错）。